患者，女性，52岁，因口腔黏膜反复起疱9个多月就诊，疱破后成溃疡，伴有疼痛。检查发现：口腔黏膜有多处鲜红糜烂面。红糜烂面边缘有疱壁残留，揭疱壁时，可同时揭去周围正常黏膜。本治疗首选药物的起始量一般为
A. 10～30mg/d
B. 60～100mg/d
C. 150～200mg/d
D. 200～300mg/d
E. 230～430mg/d

正确答案：B。60～100mg/d

解析：本题考查天疱疮的治疗。患者，女性，因口腔黏膜反复起疱9个多月就诊，疱破后成溃疡（水疱且破溃成溃疡），伴有疼痛。检查发现：口腔黏膜有多处鲜红糜烂面（形成糜烂）。红糜烂面边缘有疱壁残留，揭疱壁时，可同时揭去周围正常黏膜（揭皮试验阳性）。综合考虑诊断为天疱疮，本治疗首选药物的起始量一般为60～100mg/d（B对）。糖皮质激素：为本病的首选药物。使用中应遵循“足量、从速、渐减、忌燥”的原则，根据用药的过程，可动态地分为起始、控制、巩固、维持四个阶段。泼尼松的起始剂量一般为60～100mg，治疗1～2周如果无新发病损出现表明剂量足够，反之则需加量或配合其他免疫抑制剂。